在流行病学调查中，可用于细菌分型的合成性代谢物是
A. 热原质
B. 酶类
C. 毒素
D. 色素
E. 细菌素

正确答案：E。细菌素

解析：细菌素（E对）是细菌某些菌株产生的一类具有抗菌作用的蛋白质，作用范围较抗生素狭窄，仅对与产生菌有亲缘关系的细菌有杀伤作用，利用细菌素可以有效地进行某些细菌的分型和病原菌的流行病学调查。热原质（A错）或称致热源，是细菌合成的一种注入人体或动物体内能引起发热反应的物质，大多是由革兰阴性菌产生，即其细胞壁的脂多糖（P29），因此不能用于细菌分型。某些细菌产生的酶类（B错）具有侵袭性，能损伤机体组织，促使细菌的扩散和侵袭，是细菌重要的致病物质（P29）。细菌产生的毒素（C错）分为外毒素和内毒素两类，在细菌致病作用中甚为重要，外毒素毒性强于内毒素（P29）。某些细菌能产生不同颜色的色素（D错），分为脂溶性和水溶性两类，有助于鉴别细菌的种类。